肌酸的合成原料是
A. 精氨酸和瓜氨酸
B. 精氨酸和甘氨酸
C. 精氨酸和鸟氨酸
D. 鸟氨酸和甘氨酸
E. 乌氨酸和瓜氨酸

正确答案：B。精氨酸和甘氨酸